因为抢救危急患者，未能及时书写病历的，有关医务人员应在抢救结束后几小时内据实补记，并加以注明
A. 1小时
B. 2小时
C. 3小时
D. 5小时
E. 6小时

正确答案：E。6小时

解析：因抢救急危患者，未能及时书写病历的，有关医务人员应当在抢救结束后6个小时内据实补记，并加以注明。严禁涂改、伪造、隐匿、销毁或者抢夺病历资料。掌握“医疗事故处理概述、预防与处置”知识点。